人体实验的道德要求不包括
A. 必须服从医学目的
B. 必须取得受试者的知情同意
C. 必须维护受试者的利益
D. 坚持实验对照的原则
E. 把医学研究放在第一位

正确答案：E。把医学研究放在第一位

解析：把医学研究放在第一位不是人体实验的道德要求。人体试验强调对受试者利益的考虑必须高于对科学和社会利益的考虑，力求使受试者最大程度受益和尽可能避免伤害，这是人体试验最重要、最核心的伦理原则（E错，为本题正确答案）。应特别注意对受试者健康的考虑应优先于科学和社会的利益，保证受试者的尊严、权利、安全和福利是伦理合理性的目的（A对）。在生物医学研究中，尊重人的核心问题就是尊重受试者自主权或知情同意权（B对）。人体试验的伦理原则包括保护受试者原则（C对）。受试者的选择与排除都要依据科学的入选与排除标准，受益与负担合理；研究设计应尽量采用随机双盲对照，以保证不同组别的随机分配；研究结果产生的利益在人群中应得到合理的分配（D对）。